用牙钳拔牙时，下列描述中错误的是
A. 扭转力适用于单个锥形根的牙
B. 摇动力适用于扁根或多根牙
C. 摇动时首先向阻力小的一侧进行
D. 牵引力不能与扭转力等结合使用
E. 钳喙应尽量向根方夹持

正确答案：D。牵引力不能与扭转力等结合使用

解析：本题考查拔牙的基本步骤-患牙脱位。用牙钳拔牙时错误的是牵引力不能与扭转力等结合使用（D错，为本题的正确答案）。拔牙时，在合理地选择适用的牙钳后，张开钳喙，沿牙面插入已被完全分离的龈沟间隙内，推进至牙颈部外形高点以下，钳喙应尽量向根方夹持（E对），保持钳喙与牙长轴平行一致，夹紧患牙。牙钳夹紧后，使牙脱离牙槽窝的运动力主要有三种：扭转，摇动和牵引，扭转主要适用于单个锥形根的牙（A对），如上颌中切牙和尖牙，扭转是通过沿牙根纵轴方向作反复的旋转，而达到撕裂牙周膜、扩大牙槽窝的目的。摇动是使牙松动的主要方式，主要适用于扁根或多根牙（B对），如下前牙、前磨牙和多根的磨牙。摇动次序是先向弹性大、牙槽骨比较薄、阻力小一侧进行（C对），而后沿唇（颊）-舌（腭）方向另一侧摇动。牵引是使患牙自牙槽窝中脱出必需的、直接的力量，一般是使患牙脱位的最后步骤，适用于任何类型的牙，牵引运动应在牙有一定的松动度后开始，并应继续与摇动或扭动结合进行。以上三种基本动作，在拔牙过程中一般不单独施行，而须根据不同牙位的解剖形态拔牙过程中有机的组合，以顺利完成手术。